既分隔左、右心室，又分隔左心室与右心房的是
A. 窦房结
B. 室间隔
C. 三尖瓣复合体
D. 左、右冠状动脉开口
E. 二尖瓣

正确答案：B。室间隔

解析：室间隔（B对）既分隔左、右心室，为室间隔膜部的室间部，又分隔左心室与右心房，为室间隔膜部的房室部。